属于特殊结构的固定桥是
A. 应力缓冲式固定桥
B. 双端固定桥
C. 种植固定桥
D. 单端固定桥
E. 复合固定桥

正确答案：C。种植固定桥

解析：属于特殊结构的固定桥有种植固定桥、固定-可摘联合桥、粘接固定桥，常用的有双端，单端固定桥，半固定桥，复合固定桥4类。掌握“固定桥的组成和分类”知识点。